合成洗涤剂是水体环境的主要污染物之一。对水体COD和BOD影响正确的是
A. COD和BOD均高
B. COD和BOD均低
C. COD高和BOD低
D. COD低和BOD高
E. C0D和BOD均不变

正确答案：A。COD和BOD均高

解析：本题考查合成洗涤剂对水体COD和BOD的影响。化学耗氧量（COD）指在一定条件下，用强氧化剂如高锰酸钾、重铬酸钾等氧化水中有机物所消耗的氧量。生化需氧量（BOD）指水中有机物在有氧条件下被需氧微生物分解时消耗的溶解氧量。合成洗涤剂对水体COD和BOD的影响均高（A对BCDE错）。